胶样小体直径及特性为
A. 5μm，为均质嗜碱性
B. 5μm，为均质嗜酸性
C. 10μm，为均质嗜碱性
D. 10μm，为均质嗜酸性
E. 15μm，为均质嗜酸性

正确答案：D。10μm，为均质嗜酸性

解析：本题考查口腔扁平苔藓与慢性盘状红斑狼疮。扁平苔藓镜下见在上皮的棘层、基底层或固有层可见胶样小体或称Civatte小体，呈圆形或卵圆形，平均直径为10μm，为均质嗜酸性（D对），PAS染色阳性呈玫瑰红色，胶样小体可能是细胞凋亡的产物。